患者，男，50岁，血压170/95mmHg，伴有双侧肾动脉狭窄，单药治疗控制血压效果不佳，宜选用的联合用药方案是
A. 利尿剂+ARB
B. β受体阻滞剂+ARB
C. 利尿剂+CCB
D. α受体阻滞剂+ACEI
E. ACEI+CCB

正确答案：C。利尿剂+CCB

解析：本题考查药物的联合应用。伴有双侧肾动脉狭窄的高血压患者宜选用利尿剂+CCB（C对）。利尿剂+CCB可降低高血压患者脑卒中发生的风险。伴有双侧肾动脉狭窄的高血压患者禁用ACEI（DE错）和ARB（AB错）类降压药物。